能产生一氧化氮从而舒张血管平滑肌的药物是
A. 硝苯地平
B. 硝酸甘油
C. 卡维地洛
D. 双嘧达莫
E. 地尔硫䓬

正确答案：B。硝酸甘油